被称为“十二经脉之海”的是
A. 督脉
B. 任脉
C. 冲脉
D. 带脉
E. 阴维脉

正确答案：C。冲脉

解析：督脉能总督一身阳经之经气，故称为“阳脉之海”（A错）。任脉能总任一身阴经之脉气，故称为“阴脉之海”（B错）。冲脉能调节十二经脉气血，故称为“十二经脉之海”或“五脏六腑之海”，冲脉亦有“血海”之称（C对）。带脉约束纵行诸经，主司带下，无别称（D错）。阴维脉维系、联络全身阴经的作用，无别称（E错）。